下列不属于软腭肌的是
A. 腭降肌
B. 腭帆张肌
C. 腭咽肌
D. 腭帆提肌
E. 腭舌肌

正确答案：A。腭降肌

解析：本题考查软腭。下列不属于软腭肌的是腭降肌（A错，为本题的正确答案）。软腭主要由黏膜、黏膜下层、腭腱膜及腭肌等组成，腭肌包括腭帆张肌（B对）、腭帆提肌（D对）、腭舌肌（E对）、腭咽肌（C对）和腭垂肌。